神经、肌肉和腺体受到阈刺激时产生反应的共同表现是
A. 收缩
B. 神经冲动
C. 动作电位
D. 感受器电位
E. 突触后电位

正确答案：C。动作电位